美国药典
A. 缩写是USP
B. 缩写是PUS
C. 现行版本是24版
D. 现行版本是25版
E. 与NF合并出版

正确答案：A、E。缩写是USP；与NF合并出版

解析：本题考查药典。《美国药典》（USP）（A对B错）由美国药典委员会编辑出版，现与《美国国家处方集》（NF） 合并出版（E对），缩写为 USP-NF 。目前， USP-NF 每年发行1版，最新版本为 2019日5月1日生效的 USP 42-NF 37（CD错）, 通常以 USP42表示。